患者。女，30岁，发现上前牙变色2年，无疼痛。检查，右上中切牙色暗黄。无光泽。无缺损，叩诊（-），电活力测试（-），X线片上根尖周未见异常。患牙有外伤史。右上中切牙可能的诊断为
A. 牙髓钙化
B. 牙内吸收
C. 牙髓坏死
D. 慢性根尖周炎
E. 氟斑牙

正确答案：C。牙髓坏死

解析：牙髓坏死：无明显自觉症状，牙冠变色，牙髓无活力。诊断要点：①无自觉症状，曾有牙髓炎或牙外伤史。②牙冠呈暗黄色和灰色并失去光泽。③冷热诊和电诊均无反应。④探诊深龋的穿髓孔无反应，开放髓腔时可有恶臭。掌握“牙髓坏死、牙髓钙化与牙内吸收”知识点。